椎弓和椎体围成
A. 椎间孔
B. 横突孔
C. 椎孔
D. 椎骨上、下切迹
E. 椎管

正确答案：C。椎孔

解析：椎弓和椎体围成椎孔，各椎孔上下贯通，构成容纳脊髓的椎管（C对E错）。椎弓根的上、下缘分别称椎上、下切迹(D错)，相邻椎骨的上、下切迹共同围成椎间孔 (A错)。